舌前2/3的边缘及外侧淋巴管一部分引流至下颌下淋巴结，另一部分引流至
A. 颏下淋巴结
B. 肩胛舌骨肌淋巴结
C. 颈深上淋巴结
D. 锁骨上窝淋巴结
E. 耳后淋巴结

正确答案：C。颈深上淋巴结

解析：舌的淋巴极为丰富，最终汇入在二腹肌后腹与肩胛舌骨肌之间沿颈内静脉排列的颈深上淋巴结。舌前2/3的边缘或外侧淋巴管一部分至下颌下淋巴结，另一部分淋巴管引流至颈深上淋巴结（特别是颈总动脉分叉处的淋巴结）。掌握“腭、舌、舌下区的局部解剖”知识点。